治疗指数表示
A. 毒效曲线斜率
B. 引起药理效应的阈浓度
C. 量效曲线斜率
D. LD₅₀与ED₅₀的比值
E. LD₅至ED₉₅之间距离

正确答案：D。LD₅₀与ED₅₀的比值

解析：本题考查治疗指数。治疗指数表示LD₅₀与ED₅₀的比值（D对）。药物LD₅₀与ED₅₀的比值表示药物的安全性，称为治疗指数（TI）。引起药理效应的阈浓度（B错）是最小有效量，即阈剂量。量效曲线斜率（C错）大小在一定程度上反映了临床用药的剂量安全范围，斜率较陡的提示药效较剧烈，较平坦的则提示药效较温和。LD₅至ED₉₅之间距离（E错）是安全范围。